输血后出现酱油色尿，呼吸困难，血压下降，见于
A. 发热反应
B. 过敏反应
C. 溶血反应
D. 细菌污染反应
E. 以上均非

正确答案：C。溶血反应

解析：诊断为溶血反应，因为病人输入十几毫升血型不合的血后立即出现呼吸困难、血压下降，随之出现血红蛋白尿，即小便颜色酱油样（C对E错）。发热反应的临床表现一般为畏寒或寒战、高热，体温可达39℃～41℃。可伴有头痛、汗出、恶心、呕吐、皮肤潮红、心悸、心动过速。反应持续30分钟至2小时后逐渐缓解（A错）。过敏反应轻者仅有皮肤局限性或全身性瘙痒、皮肤红斑、荨麻疹。严重者可出现支气管痉挛、血管神经性水肿、会厌水肿，表现为咳嗽、喘鸣、呼吸困难及腹痛、腹泻、喉头水肿，甚至窒息、过敏性休克、昏迷、死亡（B错）。细菌污染反应临床表现，轻者可仅有发热，重者可立即出现内毒素性体克（如大肠杆菌或绿脓杆菌）和DIC。症见烦躁、寒战、高热、呼吸困难、恶心、呕吐、发绀、腹痛和休克。也可以出现血红蛋白尿、急性肾衰竭、肺水肿，甚至短期内死亡（D错）。